艾滋病最初的口腔表现常常是
A. 人类乳头瘤病毒
B. 人类免疫缺陷病毒
C. 口腔白色念珠菌感染
D. 唇疱疹
E. 口腔毛状白斑

正确答案：C。口腔白色念珠菌感染

解析：本题考查艾滋病的临床表现。艾滋病最初的口腔表现常常是口腔白色念珠菌感染（C对）。口腔念珠菌病在HIV感染者的口腔损害中最为常见，且常在疾病早期就表现出来，是免疫抑制的早期征象。人类乳头瘤病毒（A错）、人类免疫缺陷病毒（B错）均不是口腔表现。唇疱疹（D错）为HIV感染者常见的疱疹病毒损害。口腔毛状白斑（E错）是艾滋病在口腔黏膜最典型的损害之一。这两个都不是最早的。